牙槽骨的生物学特点是
A. 一般不发生吸收
B. 对压力有强的耐受
C. 受牵拉时增生
D. 形态结构稳定
E. 不受牙齿的影响

正确答案：C。受牵拉时增生

解析：牙槽骨的形态结构很不稳定，在一生之中随着内外环境的影响而不断发生改建。其具体表现为受压时吸收，受牵拉时增生。牙槽骨容易受到牙齿的影响，这也是正畸治疗的理论基础。掌握“牙槽骨”知识点。